男性，56岁，反复上腹痛1年，进食后呕吐1个月，呕吐物含有宿食。查体：贫血貌、消瘦，上腹可见胃型，可闻及振水音。患者最早出现的酸碱失衡和水电解质紊乱的类型是
A. 低钾血症、代谢性碱中毒
B. 高钾血症、代谢性酸中毒
C. 高钾血症、代谢性碱中毒
D. 低钾血症、代谢性酸中毒
E. 低氯血症、代谢性酸中毒

正确答案：A。低钾血症、代谢性碱中毒

解析：患者最早出现的酸碱失衡和水电解质紊乱的类型应是低氯血症、低钾血症和代谢性碱中毒（A对）。患者长时间反复呕吐，造成胃液丧失过多，可丧失大量的H⁺及Cl⁻（造成低氯血症）。肠液中的HCO₃⁻未能被胃液的H⁺所中和，HCO₃⁻被重吸收入血，使血浆HCO₃⁻增高。另外，胃液中Cl⁻的丢失使肾近曲小管的Cl⁻减少，为维持离子平衡，代偿性地重吸收HCO₃⁻增加，导致碱中毒。大量胃液的丧失也丢失了Na⁺，在代偿过程中，K⁺和Na⁺的交换、H⁺和Na⁺的交换增加，即保留了Na⁺，但排出了K⁺及H⁺，造成低钾血症和碱中毒。